下列哪种食用色索经动物实验报道有致癌性
A. 胭脂红
B. 新红
C. 赤鲜红
D. 苋菜红
E. 亮蓝

正确答案：D。苋菜红